淋病奈瑟球菌直径约为
A. 0.2～0.4μm
B. 0.4～0.6μm
C. 0.6～0.8μm
D. 0.8～1.0μm
E. 1.0～1.2μm

正确答案：C。0.6～0.8μm

解析：淋病奈瑟球菌形态与染色：革兰氏阴性球菌，多在中性粒细胞内，直径0.6～0.8μm，呈咖啡豆状（或肾形）成双排列，大多有菌毛，无鞭毛，不形成芽胞，无荚膜。掌握“肠球菌属及奈瑟菌属”知识点。